下列哪项不属于针灸选穴原则
A. 对证选穴
B. 对症选穴
C. 近部取穴
D. 远部取穴
E. 上下取穴

正确答案：E。上下取穴

解析：选穴原则是指临证选取穴位应该遵循的基本法则，包括近部选穴、远部选穴和辨证、对症选穴。按部位配穴法是结合腧穴分布部位进行穴位配伍的方法，主要包括上下配穴法第十版针灸学（E错，为本题正确答案）、前后配穴法、左右配穴法。近部选穴（C对）和远部选穴（D对）是针对病变部位较为明确的疾病而确定的选穴原则；辨证选穴（A对）和对症选穴（B对）则是针对疾病表现出的证候或某些主要症状而确定的选穴原则。